截至2014年7月23日，全球共有21个国家累计报告中东呼吸综合征（MERS）实验室确诊病例837例，死亡291例，利用该信息计算得34.8%是
A. 患病率
B. 死亡率
C. 病死率
D. 相对比
E. 发病率

正确答案：C。病死率